王某，女性，45岁。下肢痿软无力，身体困重，胸脘痞闷，小便短赤涩痛，苔黄腻，脉细数，治疗应选用
A. 清燥救肺汤
B. 加味二妙散
C. 参苓白术散
D. 虎潜丸
E. 加味四斤丸

正确答案：B。加味二妙散

解析：患者湿热浸渍肌肤，故见身体困重；湿热浸淫筋脉，气血凝滞故见下肢痿软无力；胸脘痞闷乃湿阻气机之证；湿热下注故见小便短赤涩痛；苔黄腻，脉细数，均属于痿证湿热浸淫证的特点，治法为清热利湿，通利筋脉，方药选用加味二妙散加减（B对）。清燥救肺汤（A错）可以清热润肺，濡养筋脉，用于治疗痿证肺热津伤证。参苓白术散（C错）可以健脾益气，渗湿止泻，用于治疗脾胃亏虚，精微不运之证。虎潜丸（D错）可以补益肝肾，强筋壮骨，用于治疗肝肾亏虚证。加味四斤丸（E错）可以补肝肾，养精血，壮筋骨，用于治疗肝肾俱虚，精血不足证，筋骨痿弱，不自胜持。